慢性肺源性心脏病失代偿期患者，同时合并二型呼吸衰竭，为减轻双下肢水肿，大量应用袢利尿剂，可能出现的酸碱失衡是
A. 呼碱
B. 呼酸合并代碱
C. 代碱
D. 呼酸合并代酸
E. 呼酸

正确答案：B。呼酸合并代碱

解析：根据题干患者诊断为慢性肺源性心脏病失代偿期，同时合并Ⅱ型呼吸衰竭，Ⅱ型呼吸衰竭即高碳酸症性呼吸衰竭，血气分析特点是PaO₂<60mmHg,同时伴有PaCO₂＞50mmHg，根据有PaCO₂＞50mmHg可确定为呼吸性酸中毒。大量应用袢利尿剂是发生代谢性碱中毒病因之一（B对）。